消费者有权要求经营者提供质量保障、价格合理、计量正确的商品，这种消费者权利属于
A. 自主选择权
B. 公平交易权
C. 真情知悉权
D. 安全保障权

正确答案：B。公平交易权

解析：本题考查消费者的权利。消费者有权要求经营者提供质量保障、价格合理、计量正确的商品，这种消费者权利属于公平交易权（B对）。消费者的权利：消费者的权利是消费者在消费活动中所依法享有的各种权利的总称。消费者权益保护法为消费者设立了既相互独立又相互关联的多项重要权利。（一）安全保障权（D错）：消费者在购买、使用商品和接受服务时享有人身、财产安全不受损害的权利。消费者有权要求经营者提供的商品和服务，符合保障人身、财产安全的要求。（二）真情知悉权（C错）：消费者享有知悉其购买、使用的商品或者接受的服务的真实情况的权利。消费者有权根据商品或者服务的不同情况，要求经营者提供商品的价格、产地、生产者、用途、性能、规格、等级、主要成分、生产日期、有效期限、检验合格证明、使用方法说明书、售后服务，或者服务的内容、规格、费用等有关情况。（三）自主选择权（A错）：消费者享有自主选择商品或者服务的权利。消费者有权自主选择提供商品或者服务的经营者，自主选择商品品种或者服务方式；自主决定购买或者不购买任何一种商品、接受或者不接受任何一项服务。消费者在自主选择商品或者服务时，有权进行比较、鉴别和挑选。（四）公平交易权：消费者享有公平交易的权利。经营者与消费者进行交易，应当遵循自愿、平等、公平、诚实信用的原则。消费者在购买商品或者接受服务时，有权获得质量保障、价格合理、计量正确等公平交易条件，有权拒绝经营者的强制交易行为。（五）获取赔偿权：消费者因购买、使用商品或者接受服务受到人身、财产损害的，享有依法获得赔偿的权利。消费者的求偿权，既包括人身损害的赔偿请求权，也包括财产损害的赔偿请求权。（六）结社权：消费者享有依法成立维护自身合法权益的社会组织的权利。消费者协会和其他消费者组织是依法成立的对商品和服务进行社会监督的保护消费者合法权益的社会组织。消费者协会履行下列公益性职责：一是向消费者提供消费信息和咨询服务，提高消费者维护自身合法权益的能力，引导文明、健康、节约资源和保护环境的消费方式；二是参与制定有关消费者权益的法律、法规、规章和强制性标准；三是参与有关行政部门对商品和服务的监督、检查；四是就有关消费者合法权益的问题，向有关部门反映、查询，提出建议；五是受理消费者的投诉，并对投诉事项进行调查、调解；六是投诉事项涉及商品和服务质量问题的，可以委托具备资格的鉴定人鉴定，鉴定人应当告知鉴定意见；七是就损害消费者合法权益的行为，支持受损害的消费者提起诉讼或者依照法律提起诉讼；八是对损害消费者合法权益的行为，通过大众传播媒介予以揭露、批评。消费者协会应当认真履行保护消费者合法权益的职责，听取消费者的意见和建议，接受社会监督。各级人民政府对消费者协会履行职责应当予以必要的经费等支持。依法成立的其他消费者组织依照法律、法规及其章程的规定，开展保护消费者合法权益的活动。（七）知识获取权：消费者享有获得有关消费和消费者权益保护方面的知识的权利。消费者应当努力掌握所需商品或者服务的知识和使用技能，正确使用商品，提高自我保护意识。（八）受尊重权：消费者在购买、使用商品和接受服务时，享有人格尊严、民族风俗习惯得到尊重的权利，享有个人信息依法得到保护的权利。（九）监督批评权：消费者享有对商品和服务以及保护消费者权益工作进行监督的权利。消费者有权检举、控告侵害消费者权益的行为和国家机关及其工作人员在保护消费者权益工作中的违法失职行为，有权对保护消费者权益工作提出批评、建议。